女性，呼吸困难伴胸闷10月，近1月加重，行X片可见双肺大片磨玻璃影，可见融合，血象示白细胞升高，中性粒细胞升高，判断是哪种疾病
A. 间质性肺炎
B. 肺癌
C. 支扩伴感染
D. 浸润型肺结核
E. 病毒性肺炎

正确答案：A。间质性肺炎

解析：该患者女性，出现呼吸困难伴胸闷，近1月加重，X片检查可见双肺大片磨玻璃影，可见融合，血象示白细胞升高，中性粒细胞升高，结合患者的表现和辅助检查，判断为间质性肺炎（A对）。肺癌：（B错）咳嗽为早期症状，常为无痰或少痰的剌激性干咳。多为持续性，呈高调金属音性咳嗽或刺激性呛咳。 黏液型腺癌可有大量黏液痰。痰血、咳血或咯血多见于中央型肺癌。肿瘤向管腔内生长者可有间歇或持续性痰中带血，如果表面糜烂严重侵蚀大血管，则可引起大咯血。当支气管扩张伴急性感染时（C错），病人可表现为咳嗽、咳脓痰和伴随肺炎。浸润性肺结核（D错）：浸润渗出性结核病变和纤维干酪增殖病变多发生在肺尖和锁骨下，影像学检查表现为小片状或斑点状影，可融合和形成空洞。（P51）病毒性肺炎（E错）但起病较急，发热、头痛、全身酸痛、倦怠等全身症状较突出，常在急性流感症状尚未消退时即出现咳嗽，少痰或白色粘痰、咽痛等呼吸道症状。以上四种疾病的X片不会出现双肺大片磨玻璃影，故除外。